阿托品解救有机磷酸酯类中毒时不能解除
A. 瞳孔缩小
B. 骨骼肌震颤
C. 大小便失禁
D. 中枢神经系统中毒症状
E. 皮肤潮湿

正确答案：B。骨骼肌震颤